患者，男，38岁。素患腰痛，近日因劳累后症状加重，腰部触之僵硬，俯仰困难，其痛固定不移，舌紫暗，脉弦涩。治疗除取主穴外，还应加
A. 膈俞、次髎
B. 命门、阳陵泉
C. 腰阳关、养老
D. 命门、志室
E. 次髎、阳陵泉

正确答案：A。膈俞、次髎

解析：本题考查常见的病症的辩证、处方。患者腰痛，其腰部触之僵硬，俯仰困难，其痛固定不移，呈现瘀血腰痛之象，舌脉亦是佐证，故主穴外加膈俞，次髎穴在此可为局部阿是穴（A对）。命门、阳陵泉无活血化瘀之功（B错）。腰阳关可用于寒湿腰痛，非此证（C错）。志室适用于膀胱经腰痛（D错）。阳陵泉无活血化瘀之功（E错）。